菌斑指数与软垢指数的相同点是
A. 只考虑龈缘处菌斑厚度
B. 不估计牙面菌斑的面积
C. 检查前先漱口
D. 吹干牙面后检查
E. 使用镰形探针

正确答案：E。使用镰形探针

解析：本题考查菌斑指数与软垢指数的相同点。检查软垢指数及菌斑指数时都需要使用镰形探针（E对）。菌斑指数：用视诊结合镰形探针的方法检查。检查时用探针轻刮牙面，根据菌斑的量和厚度记分（A错）。检查菌斑指数时，患者先用清水漱口，然后用棉签或小棉球蘸取药，不用吹干牙面（D错）。软垢指数：检查软垢以视诊为主，根据软垢面积按标准记分，当视诊困难时，可用镰形探针自牙颈缘1/3处向颈部轻刮。目测菌斑、软垢、色素或牙石占据牙面的面积，因此软垢指数的检查需要估计牙面菌斑的面积（B错）。软垢指数检查时不需漱口（C错），直接检查即可。